足月产，宫口开全，S+3，胎心率90/分，晚期减速，此时应采取的措施为
A. 立刻剖宫产
B. 观察
C. 静滴缩宫素
D. 硫酸镁静滴
E. 产钳助产

正确答案：E。产钳助产

解析：宫口开全，S+3，胎心率90/分，晚期减速（Ⅲ类电子胎心监护图形），应立即行产钳助产 （E对A错）；治疗首先要给孕妇吸氧，提高氧流量。其次停止静滴缩宫素（C错）或其他刺激宫缩的方法。再次改善体位，减少对胎儿的压迫。